煤焦油、矿物油等混合物中含有的致癌物主要是
A. 氯丙烯
B. 氯甲醚
C. 苯并（a）芘
D. 芳香胺类
E. β-萘胺

正确答案：C。苯并（a）芘